患者，女，25岁。口舌生疮，心烦失眠，小便黄赤，尿道灼热涩痛，口渴，舌红无苔，脉数。其病位在
A. 心、脾
B. 小肠
C. 膀胱
D. 心、小肠
E. 肾、膀胱

正确答案：D。心、小肠

解析：口舌生疮，心烦失眠说明心经有热。小便黄赤，尿道灼热涩痛说明小肠或膀胱有热。因为心与小肠病理上相互影响。心经实火，可移热于小肠，引起尿少、尿赤涩刺痛、尿血等小肠实热的症状，可以推测出本体病位在心与小肠（D对），没有消化系统的问题，所以可以排除脾（A错）。口舌生疮，心烦失眠不是肾的问题，故可以排除肾（E错）。